体内药量与血量浓度的比值称为
A. 速率常数
B. 生物等效性
C. 表观分布容积
D. 稳态血药浓度
E. 相对生物利用度

正确答案：C。表观分布容积

解析：本题考查的是常用的药物动力学参数。体内药量与血量浓度的比值称为表观分布容积（C对）。常用的药物动力学参数有：1.速率常数（A错）：速率常数是描述药物转运（消除）速度的重要的动力学参数。2.生物半衰期（t1/2）：生物半衰期是指体内药量或血药浓度消除一半所需要的时间。生物半衰期是衡量一种药物从体内消除速度的参数。3.表观分布容积（V）：表观分布容积是体内药量与血药浓度间关系的一个比例常数，用V表示。表观分布容积的大小反映了药物的分布特性。4.体内总清除率（TBCL）：体内总清除率或清除率是指单位时间内从机体或器官能清除掉相当于多少体积的体液中的药物。清除率常用Cl表示。5.生物利用度：生物利用度是指药物吸收进入血液循环的程度与速度。生物利用度包括两方面的内容：生物利用程度与生物利用速度。（1）生物利用程度（EBA）：即药物进入血液循环的多少。可通过血药浓度-时间曲线下的面积表示。试验制剂与参比制剂的血药浓度-时间曲线下面积（AUC）的比率称为相对生物利用度（E错）。当参比制剂是静脉注射剂时，则得到的比率为绝对生物利用度。（2）生物利用速度（RBA）：即药物进入体循环的快慢。生物利用度研究中，常用血药浓度达到峰浓度（Cmax）的时间（tmax）比较制剂中药物吸收的快慢。6.生物等效性（B错）：生物等效性是指含有相同活性物质的两种药品药剂学等效或药剂学可替代，并且它们在相同摩尔剂量下给药后，生物利用度（速度和程度）落在预定的可接受限度内，即两种制剂具有相似的安全性和有效性。稳态血药浓度（D错），2022年考试指南未明确说明。稳态血药浓度是指给药的速率与消除的速率达到平衡时的血药浓度。